仅用于解热、镇痛的非处方药
A. 对乙酰氨基酚
B. 布洛芬
C. 西咪替丁
D. 氢化可的松
E. 氢溴酸右美沙芬

正确答案：A。对乙酰氨基酚

解析：本题考查解热、镇痛药。对乙酰氨基酚（A对）为最常用的解热镇痛药，解热作用与阿司匹林相似，镇痛作用较弱，无抗炎抗风湿作用，作用缓和而持久，适宜老年人和儿童服用，为非处方药；布洛芬（B错）既有解热、镇痛作用，也有抗炎作用。属于“双跨药”，用于治疗类风湿性关节炎是处方药，用于解热、镇痛是非处方药；西咪替丁（C错）为H₂受体拮抗剂，能明显地抑制食物、组胺、五肽胃泌素、咖啡因与胰岛素等刺激引起的胃酸分泌。其口服制剂为非处方药，注射液为处方药；氢化可的松（D错）属糖皮质激素，具有抗炎、抗毒、抗休克作用，也具有免疫抑制作用及一定的盐皮质激素活性等。属“双跨药”，用于内服、注射是处方药，而外用是非处方药；右美沙芬（E错）通过抑制延髓咳嗽中枢而发挥中枢性镇咳作用，其镇咳强度与可待因相等或略强，无镇痛作用，长期应用未见耐受性和成瘾性，为非处方药。